某患者，刷牙时牙龈出血半年。检查：牙面菌斑较多，牙龈色红。探诊出血，初步印象为慢性龈缘炎，为与早期牙周炎鉴别，最重要的临床检查是
A. 探诊深度
B. 龈沟液量
C. 拍全口曲面断层X片
D. 牙动度
E. 有无附着丧失

正确答案：E。有无附着丧失

解析：当牙龈有炎症时，龈沟的探诊深度可达3mm以上，但上皮附着的位置仍在釉牙骨质界处，临床上不能探到釉牙骨质界，也就是此时尚无附着丧失，也无牙槽骨吸收，形成的是假性牙周袋，所以是否有附着丧失是区别牙龈炎与牙周炎的关键指征。掌握“慢性龈炎”知识点。